关于新型隐球菌的特点，哪项错误
A. 多数是外源性感染
B. 主要经消化道传播
C. 菌体外有肥厚的荚膜
D. 主要存在土壤和鸽粪中
E. 最易侵犯中枢神经系统

正确答案：B。主要经消化道传播